滑脉往来流利，如盘走珠，可见于
A. 虚热
B. 血瘀
C. 实热
D. 气滞
E. 血虚

正确答案：C。实热

解析：本题考查滑脉的脉象与主病。滑脉往来流利，如盘走珠，可见于实热（C对）。滑脉与主病[脉象]“往来流利，如盘走珠”，指下有一种圆滑感。[主病]痰饮、食滞、实热等。数脉与主病[脉象]一息脉来五至以上（相当于每分钟脉搏在90次以上），“去来促急”。[主病]主热证。有力为实热，无力为虚热（A错）。涩脉与主病[脉象]往来艰涩不畅，有如轻刀刮竹。[主病]气滞（D错）、血瘀（B错）、精伤、血少。虚脉与主病[脉象]三部脉举按皆无力，隐隐蠕动于指下，令人有一种软而空豁的感觉，是无力脉的总称。[主病]气血两虚（E错），尤多见于气虚。